适用于外感久咳，表证不著的方剂是
A. 苏子降气汤
B. 定喘汤
C. 止嗽散
D. 小青龙汤
E. 旋覆代赭汤

正确答案：C。止嗽散

解析：止嗽散方中紫菀、百部甘苦而微温，入肺经，为止咳化痰要药，共用为君。桔梗苦辛而性平，善于宣肺止咳；白前辛苦微温，长于降气化痰。荆芥辛而微温，疏风解表，以祛在表之余邪；陈皮行气化痰，为佐药。甘草合桔梗以利咽止咳，兼能调和诸药，是为佐使之用。诸药配伍，肺气得宣，外邪得散故适用于外感久咳，表证不著（C对）。苏子降气汤（A错）的功用为降气平喘，祛痰止咳，主治上实下虚之喘咳证。定喘汤（B错）的功用为宣降肺气，清热化痰，主治痰热内蕴，风寒外束之哮喘。小青龙汤（D错）的功用为解表散寒，温肺化饮，主治外寒内饮证。旋覆代赭汤（E错）的功用为降逆化痰，益气和胃，主治胃虚痰气逆阻证。